受精一般不超过排卵后
A. 5小时内
B. 6小时内
C. 12小时内
D. 24小时内
E. 48小时内

正确答案：D。24小时内

解析：卵巢排出的卵子（次级卵母细胞）在输卵管壶腹部与峡部连接处与精子结合，其过程称为受精，受精多数在排卵后数小时发生，一般不超过24小时。掌握“妊娠生理”知识点。